主治肝血不足，虚烦失眠的是
A. 酸枣仁汤
B. 龙胆泻肝汤
C. 黄连温胆汤
D. 归脾汤
E. 六味地黄丸合交泰丸

正确答案：A。酸枣仁汤

解析：酸枣仁汤中酸枣仁养血补肝，宁心安神；茯苓宁心安神；知母滋阴润燥、清热除烦；川芎辛散，调肝血，疏肝气。川芎与酸枣仁相伍，寓散于收，补中有行，共奏养血调肝之功。甘草和中缓急，调和诸药。合而成方，共奏养血安神、清热除烦之功，主治肝血不足，虚热内扰之虚烦不眠证（A对）。龙胆泻肝汤主治肝胆实火上炎证和肝经湿热下注证（B错）。黄连温胆汤主治伤暑汗出，身不大热，烦闷欲呕，舌黄腻（C错）。归脾汤主治心脾心血两虚和脾不统血证（D错）。六味地黄丸合交泰丸主治不寐之心肾不交（E错）。